血尿病人，膀胱镜检见膀胱三角区有4cm×5cm大小肿瘤，无蒂，表面有坏死，活检为T3期，最佳的治疗方案应为
A. 化疗+放疗
B. 肿瘤切除术
C. 膀胱部分切除术
D. 膀胱全切除
E. 髂内动脉栓塞

正确答案：D。膀胱全切除

解析：该患者有血尿，膀胱镜检示膀胱三角区肿瘤，故考虑为膀胱癌，且已达T3期，肿块4cm×5cm大小，故最佳的治疗方法为根治性膀胱全切除术（D对）。化疗+放疗（A错）只是其辅助治疗措施之一。经尿道膀胱肿瘤电切术（TURBt）（B错）主要用于Ta、T1期肿瘤。膀胱部分切除术（C错）适用于T2、T3期低级别、局限的肿瘤或病人不能耐受膀胱全切者。髂内动脉栓塞（E错）一般不用于膀胱癌的治疗。关于不同临床分期膀胱癌的治疗现总结如下：Tis（原位癌）可行化疗药物或卡介苗（BCG）膀胱灌注治疗。Ta、T1期肿瘤行经尿道膀胱肿瘤电切术（TURBt），术后行膀胱灌注化疗。T2期低级别、局限的肿瘤可经尿道切除或行膀胱部分切除术。T3期低级别、单个局限、如病人不能耐受膀胱全切者可采用膀胱部分切除术；膀胱浸润性癌行根治性膀胱全切除术。T4期肌层浸润性癌常失去根治性手术机会，采用姑息性放化学治疗。